人体的主要散热部位是
A. 皮肤
B. 呼吸道
C. 消化道
D. 肺循环
E. 泌尿道

正确答案：A。皮肤